能使肿瘤发生出血性坏死的细胞因子
A. 白细胞介素
B. 干扰素
C. 肿瘤坏死因子
D. 集落刺激因子
E. 趋化因子

正确答案：C。肿瘤坏死因子

解析：肿瘤坏死因子（TNF）是能使肿瘤发生出血性坏死的细胞因子。掌握“细胞因子及受体”知识点。